用治湿阻气滞之脘腹胀闷，腹痛及咳喘多痰宜选
A. 佩兰
B. 砂仁
C. 厚朴
D. 藿香
E. 白豆蔻

正确答案：C。厚朴

解析：厚朴既能燥湿消痰，又能下气除满，多用于治疗湿滞伤中，脘痞吐泻，腹胀便秘，痰饮喘咳（C对）。佩兰（A错）气味芳香，既能化湿，又能解暑，用于治疗湿浊中阻，脘痞呕恶，暑湿表证，湿温初起，胸闷不舒。砂仁（B错）辛散温通，气味芳香，用于治疗湿浊中阻，脘痞不饥，脾胃虚寒，呕吐泄泻，妊娠恶阻，胎动不安。藿香（D错）气味芳香，既能化湿和中，又能发表解暑，用于治疗湿浊中阻，脘腹痞闷，呕吐，暑湿表证，湿温初起，胸闷不舒。白豆蔻（E错）既能化湿行气，又能开胃消食，用于治疗湿浊中阻，不思饮食，脘腹胀痛，湿温初起，胸闷不饥，寒湿呕逆。